书写中枢位于
A. 额中回后部
B. 额下回后部
C. 角回
D. 缘上回
E. 无

正确答案：A。额中回后部

解析：书写中枢位于额中回后部（A对）。